某男，34岁。胃痛隐隐，绵绵不休，喜温喜按，劳累，受凉或空腹时疼痛明显，进食后疼痛缓解，时呕清水，神疲纳少，四肢倦怠，手足不温，大便溏薄，舌淡苔白，脉虚弱。医师诊断为胃痛，证属脾胃虚寒，处方如下：炙黄芪9g，桂枝9g，白芍18g，生姜6g，炙甘草9g；大枣6g，饴糖10g，7剂水煎服每日1剂早、午、晚分服。以下有关药师对此患者的用药教育内容，正确的是
A. 重视精神的调摄，避免过度劳累
B. 汤剂水煎温服，每日2次，宜餐后服用
C. 方中大枣宜擘开入煎；饴糖宜冲
D. 嘱患者服中药疼痛不缓解可服用水杨酸类止痛药
E. 嘱患者少食多餐，多吃高纤维食物

正确答案：A。重视精神的调摄，避免过度劳累

解析：本题考查的是胃痛的健康指导。胃痛隐隐，绵绵不休，喜温喜按，劳累，受凉或空腹时疼痛明显，进食后疼痛缓解，时呕清水，神疲纳少，四肢倦怠，手足不温，大便溏薄，舌淡苔白，脉虚弱。医师诊断为胃痛，证属脾胃虚寒，处方如下：炙黄芪9g，桂枝9g，白芍18g，生姜6g，炙甘草9g；大枣6g，饴糖10g，7剂水煎服每日1剂早、午、晚分服。以下有关药师对此患者的用药教育内容，正确的是选用盐炒白芍，增强补益作用（A对）。胃痛脾胃虚寒证：【症状】胃痛隐隐，绵绵不休，喜温喜按，空腹痛甚，得食痛缓，劳累或受凉后发作或加重，时呕清水，神疲纳少，四肢倦怠，手足不温，大便溏薄。舌淡苔白，脉虚弱或迟缓。【方剂应用】基础方剂为：1.基础方剂：黄芪建中汤（炙黄芪、桂枝、生姜、芍药、炙甘草、大枣、饴糖）加减。2.合理用药与用药指导：（1）饮片选择：黄芪建中汤出自东汉《金匮要略》。宜选用清炙黄芪，性偏温，补气之力增强，且有健脾和胃之功，清炙者则补而不腻；选用炒白芍，寒性已缓，长于养血和络，缓脾止痛；饴糖宜选用麦芽糖，补中益气，缓急止痛。（2）剂量建议：原方中芍药用量最大，是桂枝、甘草、生姜剂量的两倍，黄芪仅用一两半，饴糖用一升。（3）煎法服法：水煎温服，每日3次，宜餐前或餐后1小时服用（B错）。大枣宜擘开入煎；饴糖不入煎剂，临用时烊化兑服（C错）。【中成药应用】常用中成药有黄芪健胃膏、温胃舒胶囊、胃疡灵颗粒、虚寒胃痛胶囊。胃痛的健康指导：1.饮食宜忌：本病发病，与饮食不节有关。患者要养成有规律的生活与饮食习惯，忌暴饮暴食，饥饱不匀。胃痛持续不已者，应在一定时期内进流质或半流质饮食，少食多餐，以清淡易消化的食物为宜，忌粗糙多纤维饮食（E错），尽量避免进食浓茶、咖啡和辛辣食物，进食宜细嚼慢咽。慎用水杨酸、肾上腺皮质激素等西药（D错）。2.日常调护：本病发病，与情志不遂有关。患者在预防上要重视精神的调摄，同时保持乐观的情绪，避免过度劳累与紧张也是预防本病复发的关键。